男，25岁。3年来劳累时感心前区闷痛及头晕。查体：胸骨左缘第3、4肋间可闻及4/6级收缩期喷射样杂音，无震颤。可使杂音减轻的因素是
A. 口服地高辛
B. 静脉滴注硝酸甘油
C. 口服硝酸异山梨酯
D. 口服美托洛尔
E. 静脉推注毛花苷丙

正确答案：D。口服美托洛尔

解析：患者青年男性，劳累时感胸痛及头晕，查体：胸骨左缘第3、4肋间可闻及4/6级收缩期喷射样杂音（提示流出道梗阻），考虑诊断为肥厚型梗阻性心肌病。美托洛尔为β受体拮抗剂，减弱心肌收缩力，使心输出量减少，从而使杂音减弱（D对）。地高辛（A错）和毛花苷丙（E错）均属于洋地黄制剂，为正性肌力药物，可增加心肌收缩力而使杂音增强；硝酸甘油（B错）和硝酸异山梨酯（C错）属于硝酸酯类药物，通过扩张静脉降低心脏后负荷而使杂音增强。